关于小儿时期白细胞总数的特点，正确的是
A. 3岁时接近成人水平
B. 1个月时平均15×10⁹/L
C. 初生时为30~40×10⁹/L
D. 婴儿期约10×10⁹/L
E. 1周时平均为20×10⁹/L

正确答案：D。婴儿期约10×10⁹/L

解析：初生时白细胞数为15×10⁹/L～20×10⁹/L（C错），生后6～24小时升高达21×10⁹/L～28×10⁹/L，然后逐渐下降，1周后平均12×10⁹/L（BE错），6～12个月白细胞数维持在10×10⁹/L左右，8岁后接近成人水平（A错）。婴儿期为出生到1周岁之前，故其白细胞总数维持在10×10⁹/L左右（D对），